本胆烷醇酮
A. 作用于体温调节中枢，使体温调定点上移
B. 作用于体温调节中枢，使EP产生和释放
C. 作用于产致热原细胞，使体温调定点上移
D. 作用于产致热原细胞，使EP产生和释放
E. 作用于体温调节中枢和产致热原细胞，使体温调定点上移

正确答案：D。作用于产致热原细胞，使EP产生和释放

解析：发热是由于发热激活物作用于产EP细胞，诱导EP的产生和释放，从而引起体温升高。本胆烷醇酮属于某些体内产物，是发热激活物，故其作用于产致热原细胞，使EP产生和释放（D对）。